全口恒牙中体积最小的牙是
A. 上颌中切牙
B. 下颌中切牙
C. 上颌侧切牙
D. 下颌侧切牙
E. 下颌尖牙

正确答案：B。下颌中切牙

解析：本题考查上下颌前牙的外形及临床应用解剖。下颌中切牙（B对）是全口恒牙中体积最小的牙，形态较为对称。下颌侧切牙体积较下颌中切牙大。